眼球壁中含平滑肌的结构是
A. 角膜
B. 巩膜
C. 虹膜
D. 脉络膜
E. 视网膜

正确答案：C。虹膜

解析：眼球壁中含平滑肌的结构是睫状体和虹膜（C对）。